肺段
A. 右肺按肺动脉和支气管在肺内的分支分布，可分为10个肺段
B. 肺段支气管是主支气管的分支
C. 各肺段呈圆锥形，尖朝向肺表面，底部朝向肺门
D. 肺段在结构和功能上完全独立
E. 无

正确答案：A。右肺按肺动脉和支气管在肺内的分支分布，可分为10个肺段

解析：右肺按肺动脉和支气管在肺内的分支分布，可分为10个肺段（A对）。肺段支气管是肺叶支气管的分支（B错），肺叶支气管是主支气管的分支。肺段呈圆锥形，尖朝向肺门，底朝向肺的表面（C错）。肺段具有结构和功能的相对独立性（D错）。